标化死亡比是根据一般人群的年龄、性别专率所计算出的预期死亡数除观察死亡数，若该标化死亡比＜1，则很可能是
A. 被标化人群比一般人群的年龄偏小
B. 被标化人群的性别比例与一般人群不同
C. 被标化人群比一般人群的年龄偏大
D. 一般人群的健康状况好于被标标化人群
E. 一般人群的健康状况不如被标化人群

正确答案：E。一般人群的健康状况不如被标化人群